某女，27岁。1周前因右前臂出现鲜红色皮疹，皮疹为圆形红斑，上附糠状鳞屑，自服复方青黛胶囊，每次4粒，每天3次。服药4天后出现恶心、乏力、腹胀、身黄、目黄，遂停药就诊。入院查体：体温37℃，皮肤及巩膜黄染，无肝掌及蜘蛛痣，心肺听诊未闻及异常，腹软；实验室检查：丙氨酸氨基转移酶600U/L，天门冬氨酸氨基转移酶528U/L，总胆红素98μmol/L，甲、乙丙型肝炎病毒学检查均为阴性。经询问，患者服药期间未服用其他药物及保健品，但2年前曾服用过复方青黛胶囊，也曾出现过转氨酶升高的情况。入院对症处理后，症状缓解，复查肝功能：丙氨酸氨基转移酶100U/L，天门冬氨酸氨基转移酶98U/L，总胆红素18μmol/L。执业药师分析导致该患者出现肝损伤的原因，正确的是
A. 患者特异体质
B. 服药剂量过大
C. 服药疗程过长
D. 没有辨证用药
E. 药物相互作用

正确答案：A。患者特异体质

解析：本题考查的是中药药物不良反应的相关因素。1周前因右前臂出现鲜红色皮疹，皮疹为圆形红斑，上附糠状鳞屑，自服复方青黛胶囊，每次4粒，每天3次。服药4天后出现恶心、乏力、腹胀、身黄、目黄，遂停药就诊。入院查体：体温37℃，皮肤及巩膜黄染，无肝掌及蜘蛛痣，心肺听诊未闻及异常，腹软；实验室检查：丙氨酸氨基转移酶600U/L，天门冬氨酸氨基转移酶528U/L，总胆红素98μmol/L，甲、乙丙型肝炎病毒学检查均为阴性。经询问，患者服药期间未服用其他药物及保健品，但2年前曾服用过复方青黛胶囊，也曾出现过转氨酶升高的情况。入院对症处理后，症状缓解，复查肝功能：丙氨酸氨基转移酶100U/L，天门冬氨酸氨基转移酶98U/L，总胆红素18μmol/L。执业药师分析导致该患者出现肝损伤的原因，正确的是患者特异体质（A对）。发生不良反应的遗传因素：（1）个体差异：不同的个体对同一剂量的同一药物有不同的反应，这种个体差异是由于人体的生物学差异造成的。人类因种族和个体差异而有基因变异，人群中的差异超过1%即称为基因多态性，它可以使药物代谢受到影响表现出个体差异。（2）种族不同：不同种族对同一剂量相同药物的敏感度不同，产生的作用与反应也不同。中医学强调禀赋不同对药效的影响，意指遗传因素、身体素质对抗病能力及药物反应存在较大差异。临床上也存在不同种族对某药的治疗剂量相差多倍的现象。服药剂量过大（B错）、服药疗程过长（C错）、没有辨证用药（D错）与药物相互作用（E错）属于临床使用因素。发生不良反应的临床使用因素：1.剂量过大：中药的剂量使用范围比较大，在常规剂量下，发生不良反应的机会较少，但不可为强调疗效而随意加大用药剂量。处方中某些药物剂量的增减，很可能改变原方剂的功效和主治。大多数中药不良反应的发生，都与超剂量使用有关，如肉桂过量会发生血尿，麻黄过量出现心率加快、血压升高、心律失常等。2.疗程过长：中药与化学药一样，具有疗效和毒性的双重性。有的中药本身就有毒性。因此长期使用一些中药，也会引起中药不良反应或药源性疾病。3.辨证不准：中药有寒热温凉等药性特点，是治疗作用的基础。临床因辨证失准，寒热错投，攻补倒置，而引起不良反应或药源性疾病时有发生。热者用热药，火上加油；寒者用寒药，雪上加霜，易引发不良反应。4.配伍失度：中成药组方不合理、中药汤剂配伍不合理及中西药不合理联用等，常引发中药不良反应或药源性疾病。此外，误服、乱用、给药途径不正确等，亦常导致中药不良反应或药源性疾病。